苯海索治疗帕金森病的机制是
A. 补充纹状体中多巴胺的不足
B. 激动多巴胺受体
C. 兴奋中枢胆碱受体
D. 阻断中枢胆碱受体
E. 抑制多巴脱羧酶活性

正确答案：D。阻断中枢胆碱受体

解析：多巴胺缺失学说认为帕金森病是因纹状体内缺乏DA所致，根据药物作用机制，将临床常用于治疗PD的药物分为拟多巴胺类药和中枢M胆碱受体阻断药两类，其中M胆碱受体阻断药是最早用于治疗帕金森病的药物，因阿托品和东莨胆碱治疗帕金森病时外周抗胆碱副作用大，主要使用中枢性M胆碱受体阻断药苯海索，阻断中枢M胆碱受体（D对C错），抑制黑质2004U2-纹状体胆碱能神经功能，产生抗帕金森病作用。左旋多巴是体内合成多巴胺的前体物质，被脑内左旋芳香族氨基酸脱羧酶脱羧转化为DA，补充纹状体中多巴胺的不足（A错），产生抗帕金森病的作用。溴隐亭是非选择性中枢多巴胺受体激动剂，可激动多巴胺受体（B错），对外周多巴胺受体和α受体也有弱的激动作用，大剂量激动黑质2004U2-纹状体通路的D₂受体，产生抗帕金森病作用。卡比多巴可抑制外周多巴脱羧酶活性（E错），抑制外周左旋多巴脱羧产生多巴胺产生不良反应，临床作为左旋多巴治疗帕金森病的重要辅助药。